对患者疾病及隐私不予随意透露
A. 最优化原则
B. 患者至上原则
C. 知情同意原则
D. 保密守信原则
E. 酌情隐瞒原则

正确答案：D。保密守信原则

解析：本题考查临床诊疗和临床诊断的伦理。保密守信原则（D对）是指医务人员在对患者疾病诊疗的过程中及以后要保守患者的秘密和隐私，并遵守诚信的伦理准则。